女性40岁，中度弥漫性甲亢合并迁延性肝炎，且对抗甲状腺药物过敏，首选何种治疗
A. 硫脲类制剂
B. 碘制剂
C. 普萘洛尔
D. ¹³¹I
E. 手术

正确答案：D。¹³¹I

解析：患者中年女性，中度弥漫性甲亢合并迁延性肝炎，且对抗甲状腺药物过敏，首选¹³¹I治疗，¹³¹I适用于甲亢合并肝、肾等脏器功能损害患者。硫脲类制剂（A错）为抗甲状腺药物，适用于轻、中度病情；甲状腺轻、中度肿大；孕妇及高龄或其他不适宜手术者；手术前和¹³¹I治疗前的准备。碘制剂（B错）多用于手术前的辅助性治疗。普萘洛尔（C错）是针对手术前心率快者所使用的治疗。手术（E错）适用于继发性甲亢或高功能腺瘤、中度以上原发性甲亢、腺体较大有压迫症状，或胸骨后甲状腺肿等类型甲亢。